健康教育在帮助个人和群体掌握卫生保健知识、树立健康观念、自愿采纳有利于健康行为与生活方式的教育活动中，运用的两大手段是
A. 信息传播与网络咨询
B. 行为干预与健康监督
C. 信息传播与行为干预
D. 卫生监督与追踪观察
E. 专业指导与行为干预

正确答案：C。信息传播与行为干预